外伤冠折或牙体预备后的大面积牙本质暴露是以下哪种方法的适应证
A. 直接盖髓术
B. 间接盖髓术
C. 安抚
D. 根管治疗
E. 根尖诱导成形术

正确答案：B。间接盖髓术

解析：间接盖髓术：深龋引起的可复性牙髓炎、外伤冠折或牙体预备后的大面积牙本质暴露。掌握“盖髓术”知识点。